克拉维酸因具哪种特点可与阿莫西林配伍应用
A. 抗菌谱广
B. 是广谱β内酰胺酶抑制剂
C. 与阿莫西林竞争肾小管分泌
D. 使阿莫西林口服吸收更好
E. 使阿莫西林毒性降低

正确答案：B。是广谱β内酰胺酶抑制剂